4岁女孩，对母亲的来去都无所谓，很少纠缠母亲。你认为她对母亲的依恋属于哪种类型
A. 安全型
B. 回避型
C. 反抗型
D. 矛盾型
E. 以上都不是

正确答案：B。回避型